乙醇+呋喃唑酮的作用是
A. 产生有利的药物相互作用
B. 抑制乙醛脱氢酶
C. 造成听觉神经和肾功能不可逆损害
D. 抑制氧化代谢反应
E. 诱发硬膜下血肿

正确答案：B。抑制乙醛脱氢酶

解析：本题考查药物的相互作用。乙醇+呋喃唑酮的作用是抑制乙醛脱氢酶（B对）。甲硫四氮唑会抑制乙醛脱羧酶的活性，导致乙醛在体内聚集。